正确描述睾丸的是
A. 位于阴囊内，属外生殖器
B. 后缘有血管、神经、淋巴管出入
C. 由前、后面和上、下缘
D. 完全被包裹在睾丸鞘膜腔内
E. 下端连于输精管

正确答案：B。后缘有血管、神经、淋巴管出入

解析：睾丸位于阴囊内，属内（A错）生殖器。后缘有血管、神经、淋巴管出入（B对）。分前后缘，上下端和内外侧面（C错）。上端被附睾头遮盖，下端游离（E错）。